按《中国药典》以干燥茎作为川贝母入药的原植物有
A. 暗紫贝母
B. 甘肃贝母
C. 太白贝母
D. 梭砂贝母
E. 湖北贝母

正确答案：A、B、C、D。暗紫贝母；甘肃贝母；太白贝母；梭砂贝母

解析：本题考查的是川贝母的来源。按《中国药典》以干燥茎作为川贝母入药的原植物有暗紫贝母（A对）、甘肃贝母（B对）、太白贝母（C对）与梭砂贝母（D对）。川贝母：【来源】为百合科植物川贝母、暗紫贝母、甘肃贝母、梭砂贝母、太白贝母或瓦布贝母的干燥鳞茎。来源为湖北贝母（E错）的中药，2022年考试指南未明确说明。